男孩，初中，离异家庭，寄宿学校，一上学就腹痛，就医过程中症状缓解，查体无器质性改变，该患者可能
A. 精神性
B. 感染性
C. 神经性
D. 心身障碍
E. 自身免疫性疾病

正确答案：D。心身障碍

解析：心身障碍：是在不良心理因素的长期作用下，引起的相对持续时间较长的一种障碍，但此阶段所发生的，只是量的变化，是可逆性的，而非质的变化，并无实质性的组织性（D对）的损害。本题题干男童上学腹痛，有不良心理因素。查体无器质性改变。